威灵仙的主治病证不包括
A. 风寒湿痹
B. 瘫痪麻木
C. 痰饮积聚
D. 湿热痹痛
E. 诸骨鲠喉

正确答案：D。湿热痹痛

解析：本题考查的是威灵仙的主治病证。威灵仙的主治病证不包括湿热痹痛（D错，为本题正确答案）。威灵仙：【主治病证】（1）风寒湿痹（A对），肢体拘挛，瘫痪麻木（B对）。（2）痰饮积聚（C对），诸骨鲠喉（E对）。湿热痹痛为木通的主治病证。木通：【主治病证】（1）湿热淋痛，水肿尿少。（2）心火上炎或下移小肠之口舌生疮、心烦尿赤。（3）产后乳汁不通或乳少。（4）湿热痹痛。